某患者使用氯霉素滴眼液Ⅰ后感觉口苦，改用氯毒素滴眼液Ⅱ后该现象明显减轻，推测其较为合理的原因是
A. 滴眼液Ⅰ中氯霉素原料药苦味较重
B. 滴眼液Ⅱ中杂质含量少
C. 滴眼液Ⅰ的生产工艺不完善，在其生产过程中产生了苦味杂质
D. 滴眼液Ⅱ中有可能添加了高分子材料，增加了药液黏度
E. 滴眼液Ⅱ中可能含有矫味剂

正确答案：D。滴眼液Ⅱ中有可能添加了高分子材料，增加了药液黏度

解析：本题考查眼部药物吸收。滴眼液有部分药液通过鼻泪管到达口鼻流失，滴眼液Ⅱ增加黏度（D对）后药液流失到口鼻的量减少，口苦会明显减轻。